单室模型静脉滴注给药的血药浓度随时间变化关系式
A. C=k₀（1-e-kt）/Vk
B. logC＇=（-k/2.303）t＇+log（k₀/Vk）
C. logC＇=（-k/2.303）t＇+log［k₀（1-e-kt）/Vk］
D. logC=（-k/2.303）t+logC₀
E. logX=（-k/2.303）t+lqogX₀

正确答案：A。C=k₀（1-e-kt）/Vk